男，27岁。发热头晕视物模糊1周。血常规示Hb69g/L，WBC15×10⁹/L，分类中可见原始细胞。本患者骨髓涂片中早幼粒细胞占0.60，应诊断为哪型急性非淋巴细胞白血病
A. M1型
B. M2型
C. M3型
D. M4型
E. M5型

正确答案：C。M3型

解析：该患者考虑为急性白血病，骨髓涂片检查早幼粒细胞占0.60（M₃型骨髓涂片早幼粒细胞在NEC中≥30%），考虑诊断为M₃型急性白血病（急性早幼粒细胞白血病）（C对）。M₁型（P569）（A错）骨髓涂片原粒细胞占NEC的90%以上；M₂型（P569）（B错）骨髓涂片原粒细胞占NEC的30%～89%，其他粒细胞≥10%，单核细胞＜20%；M₄型（P569）（C错）骨髓涂片原始细胞占NEC的30%以上，各阶段的粒细胞及单核细胞分别≥20%；M₅型（P569）（D错）骨髓涂片原单核、幼单核占NEC的≥30%，各原单核、幼单核及单核细胞≥80%。